男，35岁。体重75Kg。因陈旧性股骨干骨折入院手术。查体P85次/分，BP125/80mmHg。一般状况良好，心肺无异常。实验室检查：Hb130g/L。凝血功能检查结果正常，肝肾功能正常，如果手术中出血，下列输血方案中不应首选的是
A. 术后回收式自身输血
B. 输注异体红细胞和新鲜冰冻血浆
C. 急性等容血液稀释
D. 术前贮存式自身输血
E. 术中回收式自身输血

正确答案：B。输注异体红细胞和新鲜冰冻血浆

解析：自体输血既可节约库存血，又可减少输血反应和疾病传播，且不需检测血型和交叉配合试验。目前提倡自体输血，急性等容血液稀释（C对）、术前贮存式自身输血（D对）、术中及术后回收式自身输血（AE对）均属于自体输血。输注异体红细胞和新鲜冰冻血浆（B错，为本题正确答案）可能发生输血反应。急性等容血液稀释指麻醉后、手术前采血，同时补充等容量的晶体、胶体液稀释血液，术中必要时再将保存的自体血回输给病人。术前贮存式自身输血指从择期手术前一个月开始采血，每3～4天一次，每次300～400ml，直到术前3天为止，储存采得的血液以备手术之需。回收式自体输血指将收集到的创伤后体腔内积血或手术过程中的失血，经抗凝、过滤后再回输给病人。